心室颤动时电除颤的能量选择应为
A. 单相波120J
B. 双相波100J
C. 单相波360J
D. 单相波300J
E. 单相波200J

正确答案：C。单相波360J

解析：心室颤动时电除颤的能量选择单相波360J（C对）或双相波150~200J（B错）。若第一次不成功，第二次及后续的除颤能量可与前相当或提高。